临床治疗必需、使用广泛、疗效好，同类品种中价格低的药品是
A. 《基本医疗保险药品目录》中的药品
B. 《基本医疗保险药品目录》中的“甲类目录”
C. 《基本医疗保险药品目录》中的“乙类目录”
D. 《基本医疗保险药品目录》中的中药饮片
E. 《国家基本药物目录》中的药品

正确答案：B。《基本医疗保险药品目录》中的“甲类目录”

解析：本题考查“甲类目录”。临床治疗必需、使用广泛、疗效好，同类品种中价格低的药品是《基本医疗保险药品目录》中的“甲类目录”（B对）。《城镇职工基本医疗保险用药范围管理暂行办法》第六条规定：《药品目录》中的西药和中成药在《国家基本药物》的基础上遴选，并分“甲类目录”和“乙类目录”。“甲类目录”的药品是临床治疗必需，使用广泛，疗效好，同类药品中价格低的药品。“乙类目录”的药品是可供临床治疗选择使用，疗效好，同类药品中比“甲类目录”药品价格略高的药品。第七条规定：“甲类目录”由国家统一制定，各地不得调整。“乙类目录”由国家制定，各省、自治区、直辖市可根据当地经济水平、医疗需求和用药习惯，适当进行调整，增加和减少的品种数之和不得超过国家制定的“乙类目录”药品总数的15%。各省、自治区、直辖市对本省（自治区、直辖市）《药品目录》“乙类目录”中易滥用、毒副作用大的药品，可按临床适应症和医院级别分别予以限定。